致龋力最低的糖类是
A. 龈上菌斑
B. 山梨糖醇
C. 龈下菌斑
D. 木糖醇
E. 半乳糖

正确答案：D。木糖醇

解析：本题考查龋病的临床表现与分类。糖醇类物质特别是木糖醇（D对）致龋力最弱。